公共场所经常性卫生监督的主要内容不包括
A. 对“卫生许可证”有效性的监督
B. 对各项卫生要求的监督
C. 对各项制度执行情况的监督
D. 对各类从业人员的卫生监督
E. 对公众健康状况的监督

正确答案：E。对公众健康状况的监督

解析：本题考查公共场所经常性卫生监督的主要内容。经常性卫生监督是指卫生行政部门对公共场所卫生有计划地进行定期或不定期检查、指导、监督和监测。其主要内容包括：1.对“卫生许可证”有效性的监督（A对）；2.对各项卫生要求的监督（B对）；3.对各项制度执行情况的监督（C对）；4.对各类从业人员的卫生监督（D对）。对公众健康状况的监督（E错，为本题正确答案）不属于公共场所经常性卫生监督的主要内容。